下面属于预防策略中的主动干预的是
A. 在车辆设计中改善刹车
B. 安全气囊的使用
C. 提高道路的安全性
D. 父母把有危害的药品放置到对儿童安全的地方
E. 使用安全药盒

正确答案：D。父母把有危害的药品放置到对儿童安全的地方

解析：本题考查预防策略中的主动干预。主动干预要求宿主采取措施使干预奏效，它要求人们改变某种行为、并且必须记住在每次暴露于危险行为时要实施安全行为。如安全带、头盔的应用；父母把有危害的药品放置到对儿童安全的地方（D对）等为主动干预措施。被动干预不需要宿主的行动，一般通过改善因子、媒介或环境来实现，是自动发生作用的措施。如在车辆设计中改善刹车（A错）；安全气囊的使用（B错）；提高道路的安全性（C错）；使用安全药盒（E错）等为被动干预措施。